40岁女性，左下67缺失，左下8未萌，口腔余牙均健康。（牙合）关系正常。预行固定义齿修复，正确的设计是
A. 左下45作为基牙做单端固定义齿修复
B. 左下345为基牙做单端固定义齿修复
C. 左下2345为基牙做单端固定义齿修复
D. 左下5为基牙做单端固定义齿修复
E. 不宜做单端固定义齿修复

正确答案：E。不宜做单端固定义齿修复

解析：本题考查单端固定修复的设计。患者左下67缺失，左下8未萌，患者为单侧多个磨牙游离缺失，对颌牙为天然牙，设计单端固定桥，基牙承受咬合力过大，会对基牙产生杠杆作用，易损伤基牙，故不能采用单端固定桥修复（E对ABCD错）。对于多个磨牙游离缺失的病例，牙槽骨条件允许种植者，可以借助种植基牙，设计种植基牙固定桥或种植基牙-天然牙联合固定桥，以解决末端游离缺失病例修复的问题。